视觉性语言中枢在优势半球的
A. 额中回后部
B. 额下回后部
C. 角回
D. 中央前回
E. 缘上回

正确答案：C。角回

解析：视觉性语言中枢在优势半球的角回（C对），该中枢与文字的理解和认图密切相关，损伤后可出现视觉无障碍但对原来认识的字不能阅读，也不理解文字符号的意义，称失读症。额中回后部（A错）为书写中枢所在位置，该中枢主管书写功能，损伤后可出现手部有运动功能但写字、绘图等精细动作发生障碍，称为失写症。额下回后部（B错）为运动性语言中枢所在位置，该中枢主司说话功能，损伤后出现病人能发音却不能说出具有意义的语言，称运动性失语症。中央前回（D错）为第Ⅰ躯体运动区所在位置，与管理全身骨骼肌运动相关，损伤后可出现上运动神经元性瘫痪。缘上回（E错）为Wernicke区的组成部分，与理解别人的语言及文字密切相关，损伤后可出现感觉性失语症。